应用高剂量使用β₂受体激动剂可导致的严重典型不良反应是
A. 低钾血症
B. 低钙血症
C. 高钾血症
D. 高钙血症
E. 低血镁

正确答案：A。低钾血症

解析：本题考查高剂量β₂受体激动剂的不良反应。应用高剂量使用β₂受体激动剂可导致的严重典型不良反应是低钾血症（A对）。β₂受体激动剂可能会引起低钾血症。与黄嘌呤类药物、肾上腺皮质激素、利尿药合用及缺氧都可能增加低钾血症的发生。因此，在这种情况下需监测血钾水平。